开始绘制妊娠图最好的孕周是
A. 孕10周
B. 孕20周
C. 孕30周
D. 孕35周
E. 孕40周

正确答案：B。孕20周

解析：本题考查妊娠图的相关内容。孕中期胎儿生长发育加快，子宫底在逐渐升高，孕中期产前检查不仅要测量体重、血压、腹围、宫高，听胎心，而且孕20周（B对ACDE错）开始绘制妊娠图，了解胎儿宫内发育情况。